男，52岁。烧伤病人，烧伤总面积35%，其中Ⅲ°烧伤面积10%。该患者属于烧伤的类型是
A. 轻度烧伤
B. 中度烧伤
C. 重度烧伤
D. 特重烧伤
E. 小面积烧伤

正确答案：C。重度烧伤

解析：患者为中年男性。烧伤病人，烧伤总面积35%，其中Ⅲ烧伤面积10%。该患者属于烧伤的类型是重度烧伤（C对）。八版外科学上明确给出了烧伤严重程度分度：轻度烧伤是指Ⅱ°烧伤面积10%以下（A错）；中度烧伤是指Ⅱ°烧伤面积11%～30%，或有Ⅲ°烧伤但面积不足10%（B错）；重度烧伤是指烧伤总面积31%～50%，或Ⅲ°烧伤面积11%～20%，或Ⅱ°、Ⅲ°烧伤面积虽不到上述百分比，但已发生休克等并发症，或存在较重的吸入性损伤、复合伤等；特重烧伤是指烧伤总面积50%以上，或Ⅲ°烧伤20%以上（D错）。该患者烧伤总面积为35%，根据上述分类标准，该患者属于重度烧伤。小面积烧伤（E错）是干扰选项，对于烧伤严重程度分度并无此类型。